涎瘘最常见的部位
A. 腮腺
B. 唇腺
C. 腭腺
D. 舌下腺
E. 下颌下腺

正确答案：A。腮腺

解析：涎瘘是指唾液不经导管系统排入口腔而流向面颊皮肤表面。腮腺是最常见的部位，损伤是主要的原因。掌握“涎瘘”知识点。